高血压伴痛风的患者慎用的药物是
A. 硝苯地平
B. 卡托普利
C. 氢氯噻嗪
D. 普萘洛尔
E. 特拉唑嗪

正确答案：C。氢氯噻嗪

解析：本题考查降压药。高血压伴痛风的患者慎用的药物是氢氯噻嗪（C对）。氢氯噻嗪为噻嗪类利尿药，痛风患者禁用。硝苯地平（A错）属于二氢吡啶类钙通道阻滞剂，心动过速与心力衰竭患者应慎用。卡托普利（B错）属于ACEI类降压药，禁用于双侧肾动脉狭窄、高钾血症及妊娠期。普萘洛尔（D错）属于β受体阻断剂，二至三度房室传导阻滞、严重支气管哮喘患者禁用。慢性阻塞性肺疾病、运动员、周围血管疾病或糖耐量异常者慎用。特拉唑嗪（E对）是α受体阻断剂，体位性低血压者禁用，心力衰竭者慎用。